2型非肥胖型糖尿病患者且有良好胰岛β-细胞贮备功能患者选用
A. 双胍类
B. α-葡萄糖苷酶抑制剂
C. 磺酰脲类
D. 胰岛素与胰岛素类似物
E. 血管紧张素转换酶抑制剂

正确答案：C。磺酰脲类

解析：本题考查降糖药。2型非肥胖型糖尿病患者在有良好的胰岛β细胞储备功能、无高胰岛素血症时可应用促胰岛素分泌剂（磺酰脲类（C对）和格列奈类）。二甲双胍（A错）用于2型肥胖型糖尿病患者。α-葡萄糖苷酶抑制剂（B错）用于单纯餐后血糖升高患者。胰岛素（D错）用于1型糖尿病患者。血管紧张素转换酶抑制剂（E错）用于高血压。